男，51岁。上腹部胀痛8个月，突发剧痛2小时，消瘦，贫血貌，左锁骨上淋巴结肿大3.8cm×1.5cm，质硬，全腹肌紧张，上腹明显压痛、反跳痛（+）。腹部X线透视可见膈下游离气体。下一步治疗最合理的术式为
A. 胃造瘘术
B. 胃癌根治术
C. 穿孔修补术
D. 胃空肠吻合术
E. 姑息性胃大部切除术

正确答案：E。姑息性胃大部切除术

解析：中年男性患者，上腹部胀痛8个月，消瘦、贫血貌，左锁骨上有一肿大、质硬的淋巴结（提示晚期胃癌），2小时前突发腹部剧痛，全腹肌紧张，上腹明显压痛、反跳痛（+）（腹膜刺激征），腹部X线透视可见膈下游离气体（提示腹部空腔脏器穿孔），结合患者病史、体查和影像学表现，应考虑为晚期胃癌并发穿孔。患者为晚期胃癌，有远处淋巴结转移，不能行胃癌根治术（B错），宜采用姑息性手术。（七版黄家驷外科学P1460）姑息性手术可分为姑息性胃大部切除术和空肠吻合术、空肠造口术等短路手术。研究资料表明，姑息性胃大部切除术的疗效显著高于其他姑息性手术，且不增加手术死亡率。行姑息性胃大部切除术不但可以消除肿瘤出血、穿孔等并发症，尤其在切除术后配合药物治疗，有的仍可获得较长的生存期。因此该患者下一步治疗最合理的术式为姑息性胃大部切除术（E对）。胃造瘘术（A错）主要用于晚期食管癌的患者。因癌肿自身容易出血、坏死，行单纯穿孔修补术后创口很难愈合（C错）。胃空肠吻合术（D错）等短路手术一般不能改变胃癌的自然生存曲线，仅能起到解除梗阻、缓解症状的效果，故不选。